以胆汁酸为主要有效成分的中药有
A. 麻黄
B. 洋地黄
C. 牛黄
D. 熊胆
E. 五味子

正确答案：C、D。牛黄；熊胆

解析：本题考查中药的化学成分。以胆汁酸为主要有效成分的中药有牛黄（C对）、熊胆（D对）。动物胆、胆结石的临床应用历史很悠久，从汉《神农本草经》的鲤鱼胆到明《本草纲目》止，共记载药材30余种，其中如牛黄、熊胆被视为珍贵药材，广泛应用于各种中成药制剂中，这些动物胆类药材的主要有效成分为胆汁酸。麻黄（A错）中含有多种生物碱，以麻黄碱和伪麻黄碱为主，前者占总生物碱的40%～90%，《中国药典》以盐酸麻黄碱和盐酸伪麻黄碱为指标成为对麻黄进行含量测定，要求药材和饮片含盐酸麻黄碱和盐酸伪麻黄碱的总量不得少于0.80%。毛花洋地黄（B错）化学成分：毛花洋地黄叶中含强心苷40余种，主要有毛花洋地黄苷甲、乙、丙、丁、戊和洋地黄毒苷、羟基洋地黄毒苷、吉它洛苷等。五味子（E错）中含木脂素较多，约为5%，近年来从其果实中分得了一系列联苯环辛烯型木脂素，包括五味子醇和五味子素。